油炸淀粉类食品时，丙烯酰胺生成量最多的温度为
A. 120℃
B. 140℃
C. 170℃
D. 190℃
E. 100℃

正确答案：C。170℃

解析：本题考查油炸淀粉类食品时，丙烯酰胺生成量最多的温度。油炸淀粉类食品时，丙烯酰胺的含量随油炸时间的延长明显升高，加热到120℃以上时，丙烯酰胺开始生成，适宜的温度为140～180℃，170℃（C对ABDE错）左右生成量最多。